听觉适应是指
A. 强噪声下暴露时间短，听阈提高10dB以上，离开噪声环境数分钟即可恢复
B. 一种器质性听觉器官损伤
C. 是一种永久性的听阈位移
D. 强噪声暴露时间长，听阈明显下降，听阈提高15dB，离开噪声环境后较长时间内才能恢复
E. 强噪声暴露时间长，听阈明显下降，听阈提高30dB，离开噪声环境后较长时间内才能恢复

正确答案：A。强噪声下暴露时间短，听阈提高10dB以上，离开噪声环境数分钟即可恢复

解析：本题考查听觉适应的概念。听觉适应是指短时间暴露在强烈噪声环境中，机体听觉器官敏感性下降，听阈可提高10～15dB，脱离噪声接触后对外界的声音有“小”或“远”的感觉，离开噪声环境1分钟之内即可恢复（A对BCDE错）。听觉适应是机体对于外界短时间大噪音刺激的一种适应，是可以在短时间内恢复正常的。